关于结核性胸膜炎特点的描述错误的是
A. 多见于中青年
B. 起病多缓慢
C. 可有结核中毒症状
D. X线胸片可呈肋膈角消失或外高内低影
E. X线胸片除胸液影外，还应有肺内结核灶

正确答案：E。X线胸片除胸液影外，还应有肺内结核灶

解析：结核性胸膜炎为继发性肺结核，起病缓慢（B对），多见于中青年（A对），并常伴有干咳、潮热、盗汗、消瘦等结核中毒症状（C对）。X线胸片肋膈角消失或外高内低影（D对）为胸腔积液的特征性表现。若患者为单纯结核性胸膜炎，则肺内没有结核灶（E错，为本题正确答案），肺内结核灶见于肺结核直接蔓延引起的结核性胸膜炎。